阴气不足，可见于五脏六腑，其最主要的是
A. 心阴虚
B. 脾阴虚
C. 肾阴虚
D. 胃阴虚
E. 肝阴虚

正确答案：C。肾阴虚

解析：阴虚可见于五脏六腑，如肺阴、脾阴、胃阴、心阴、肝阴和肾阴，皆可发生阴虚病变，但一般以肾阴亏虚为主（C对ABDE错）。